男性，35岁。双下肢水肿2周。查体：血压130/80mmHg，双下肢轻度凹陷性水肿。尿常规：蛋白++++，红细胞++。Scr122μmol/L。血浆白蛋白28g/L。若肾活检示肾小球系膜轻度增生，系膜区可见免疫复合物沉积，最可能的诊断为
A. 系膜增生性肾小球肾炎
B. 系膜毛细血管性肾小球肾炎
C. 微小病变性肾病
D. 局灶节段性肾小球硬化
E. 膜性肾病

正确答案：A。系膜增生性肾小球肾炎

解析：肾病综合症患者，肾活检系膜区可见免疫复合物沉积，符合系膜增生性肾小球肾炎（A对）的诊断。系膜毛细血管性肾小球肾炎（B错）镜下表现为系膜区及毛细血管壁颗粒状沉积（P473）。微小病变性肾病（C错）表现为足突融合。局灶阶段性肾小球硬化（D错）足突广泛融合、基底膜塌陷、系膜基质增多，电子致密物沉积。膜性肾病（E错）电镜下可见GBM上皮侧有排列整齐的电子致密物，常伴有广泛足突融合。均与该患者不符。